能独坐、用手摇玩具，但不会爬的年龄是
A. 9个月
B. 18个月
C. 10～11个月
D. 7～8个月
E. 6个月

正确答案：E。6个月

解析：6个月能独坐一会儿，用手摇玩具；7个月会翻身，独坐很久，将玩具换手。8个月会爬，会拍手及扶栏杆站起。掌握“体格生长常用指标”知识点。